男，35岁，发热2个月，咳痰带血3天，2年前患胸膜炎，T38℃，左肺尖密度阴影。ESR30mm/h，WBC8.0×10⁹/L，该患者的治疗为
A. SM+INH+RAS
B. 抗真菌药
C. 口服阿奇霉素
D. INH+RFP+EMB
E. 抗生素

正确答案：D。INH+RFP+EMB

解析：青年男性患者，发热2月（肺结核最常见症状），咳痰带血3天（肺结核常见可疑症状），2年前患胸膜炎，T38℃，左肺尖密度阴影（典型征象）。ESR30mm（血沉加快证明为活动性肺结核），故诊断为肺结核。治疗方案选择初治活动性肺结核治疗方案：异烟肼（INH）、利福平（RFP）、吡嗪酰胺（PZA）和乙胺丁醇（EMB），故选择INH+RFP+EMB（D对）。SM+INH+RAS中RAS一般不用于肺结核治疗（A错）。抗真菌药一般用于真菌感染（B错）。口服阿奇霉素一般用于症状以刺激性干咳为主的支原体肺炎等（C错）。抗生素一般用于感染患者，肺结核患者一般不主张使用抗生素（E错）。